土壤微生物对有机农药的生物化学作用不包括
A. 脱氯、脱烷基作用
B. 氧化还原作用
C. 环裂解作用
D. 水解作用
E. 光合作用

正确答案：E。光合作用

解析：本题考查土壤微生物对有机农药的生物化学作用。土壤微生物对有机农药的生物化学作用包括：脱氯、脱烷基（A对）、氧化还原（B对）、水解（D对）、环裂解（C对）等。光合作用（E错，为本题正确答案）通常是指绿色植物（包括藻类）吸收光能，把二氧化碳和水合成富能有机物，同时释放氧气的过程。